鉴别功血和子宫内膜息肉的最好方法是
A. 阴道脱落细胞检查
B. 基础体温测定
C. 诊刮、内膜活检
D. 子宫、输卵管造影
E. 由病史及妇科检查鉴别

正确答案：C。诊刮、内膜活检

解析：诊断性刮宫、内膜活检可以明确子宫内膜病理诊断，明确子宫内膜病变类型，故可以鉴别功血和内膜息肉。